对诊断门静脉高压最有价值的依据是
A. 肝功能异常
B. 脾大和脾功能亢进
C. 食管胃底静脉曲张
D. 腹水征阳性
E. 肝掌阳性

正确答案：C。食管胃底静脉曲张

解析：肝硬化失代偿期主要有门静脉高压和肝功能减退两类临床表现。门脉高压是由门静脉阻力增加和门静脉血流量增加引起，变现为腹水征阳性（D错）、门-腔侧支循环开放、脾大和脾功能亢进（B错），其中门-腔侧支循环开放，尤其是食管胃底静脉曲张（C对），是门静脉高压症最特征性的表现，对诊断门静脉高压最有价值。肝功能异常（A错）和肝掌阳性（E错）均为肝功能减退的表现。